可分泌到乳汁中，引起新生儿黄疸的药物是
A. 复方磺胺甲噁唑
B. 头孢克洛
C. 诺氟沙星
D. 阿莫西林
E. 华法林

正确答案：A。复方磺胺甲噁唑

解析：本题考查特殊人群用药。可分泌到乳汁中，引起新生儿黄疸的药物是复方磺胺甲噁唑（A对）。磺胺类在乳汁中的浓度与血浆中一致，在体内与胆红素竞争血浆蛋白，可致游离胆红素增高，尤其在新生儿黄疸时，可促使发生新生儿胆红素脑病（核黄疸）。头孢菌素类（B错）在乳汁中含量甚微，但第四代头孢菌素类如头孢匹罗、头孢吡肟例外。喹诺酮类（C错）对乳儿骨关节有潜在危害，不宜应用。青霉素类（D错）对乳儿安全。